骨折切开复位比闭合复位的最大优点是
A. 达到解剖复位
B. 降低感染风险
C. 制动时间缩短
D. 缩短骨折愈合时间
E. 减少骨折部位创伤

正确答案：A。达到解剖复位

解析：切开复位的最大优点是可使手法复位不能复位的骨折达到解剖复位（A对）。有效的内固定，可使病人提前下床活动，减少肌萎缩及关节僵硬，还能方便护理，减少并发症，但它并不能缩短制动时间（C错）和骨折的愈合时间（D错）。由于切开复位时分离软组织和骨膜，减少了骨折部位血供、增加了骨折部位软组织的损伤程度（E错），易发生感染，同时切开复位后多使用内固定器材，更增加了感染的风险（B错）。